治疗颞下颌关节强直引起的开口困难可选用
A. 局部封闭
B. 开口练习
C. 理疗
D. 关节镜手术
E. 开放手术

正确答案：E。开放手术

解析：本题考查颞下颌关节强直的治疗。颞下颌关节强直分为真性关节强直和假性关节强直两类。前者是由关节内纤维性或骨性粘连引起，也称关节内强直；后者是因软组织损伤产生的瘢痕限制下颌运动造成的，也称颌间挛缩。由于颞下颌关节强直是由于关节内纤维性或骨性粘连引起，或因软组织损伤产生的瘢痕限制下颌运动造成开口困难，传统的保守治疗不能解决开口困难症状，因此需开放手术（E对）治疗。翼外肌痉挛主要为咀嚼肌的功能不协调，为关节外疾患，所以翼外肌痉挛引起的张口受限可用局部封闭（A错）或理疗（C错）等方法解除肌痉挛，同时消除或尽可能减弱引起肌痉挛的因素。开口练习（B错）是在开放手术后进行，其目的是防止复发。